戒断综合征一般出现在断药后
A. 1～2小时
B. 3～5小时
C. 6～8小时
D. 12～24小时
E. 24～48小时

正确答案：C。6～8小时